治疗高热惊厥，手足抽搐者，宜选用
A. 羚羊角
B. 天南星
C. 天麻
D. 地龙
E. 白芥子

正确答案：A。羚羊角

解析：羚羊角性寒，主入肝经，长于清肝热，息肝风，止痉搐，为治肝风内动，惊痫抽搐之要药；因其清热力强，故尤宜于温热病热邪炽盛，热极动风之高热神昏、痉厥抽搐（A对）。天南星的功效为燥湿化痰，祛风止痉，散结消肿。治疗顽痰咳喘，胸膈胀闷；风痰眩晕，中风痰壅，口眼㖞斜，半身不遂，癫痫，惊风，破伤风；痈肿，瘰疬痰核，蛇虫咬伤（B错）。天麻的功效为息风止痉，平抑肝阳，祛风通络。治疗小儿惊风，癫痫抽搐，破伤风；肝阳上亢，头痛眩晕；手足不遂，肢体麻木，风湿痹痛（C错）。地龙的功效为清热定惊，通络，平喘，利尿。治疗高热神昏，惊痫抽搐，癫狂；关节痹痛，肢体麻木，半身不遂；肺热喘咳；湿热水肿，小便不利或尿闭不通（D错）。白芥子的功效为温肺豁痰，利气散结，通络止痛。治疗寒痰咳喘，悬饮胸胁胀痛；痰滞经络，关节麻木疼痛，痰湿流注，阴疽肿毒（E错）。